患儿男，5岁。患多汗、夜惊、食欲不振、消化不良、发育迟缓。宜选用的中成药是
A. 万氏牛黄清心丸
B. 健脾康儿片
C. 牛黄抱龙丸
D. 琥珀抱龙丸
E. 龙牡壮骨颗粒

正确答案：E。龙牡壮骨颗粒

解析：本题考查龙牡壮骨颗粒的主治。宜选用的中成药是龙牡壮骨颗粒（E对）。龙牡壮骨颗粒【主治】治疗和预防小儿佝偻病、软骨病；对小儿多汗、夜惊、食欲不振、消化不良、发育迟缓也有治疗作用。万氏牛黄清心丸（A错）【主治】热入心包、热盛动风证，症见高热烦躁、神昏谵语及小儿高热惊厥。健脾康儿片（B错）【主治】脾胃气虚所致的泄泻，症见腹胀便泻、面黄肌瘦、食少倦怠、小便短少。牛黄抱龙丸（C错）【主治】小儿风痰壅盛所致的惊风，症见高热神昏、惊风抽搐。琥珀抱龙丸（D错）【主治】饮食内伤所致的痰食型急惊风，症见发热抽搐、烦躁不安、痰喘气急、惊痫不安。